流行病学中，观察性研究与实验性研究的根本区别在于
A. 是否设立对照
B. 是否人为施加干预措施
C. 是否随访观察
D. 是否采用盲法
E. 是否存在医学伦理问题

正确答案：B。是否人为施加干预措施

解析：本题考查观察性研究与实验性研究的根本区别。观察性研究是在自然状态下对研究对象的特征进行观查、记录，并对结果进行描述和对比分析的研究。实验性研究是人为地进行干预措施，而收集到结果的分析性研究。二者的根本区别在于是否人为施加干预措施（B对ACDE错）。